哪种药物能防止和逆转慢性心功能不全的心室肥厚并能降低病死率
A. 地高辛
B. 米力农
C. 氢氯噻嗪
D. 硝普钠
E. 卡托普利

正确答案：E。卡托普利